3岁女孩，反复咳嗽2个月，查体：体温正常，浅表淋巴结（-），咽（-），两肺多哮鸣音，无水泡音，反复抗生素治疗不愈，以往无呛咳病史，有过敏性鼻炎。如肺部哮鸣音广而且持续存在，则不能使用
A. 氨茶碱
B. 比索洛尔
C. 地塞米松
D. 异丙肾上腺素
E. 碳酸氢钠

正确答案：B。比索洛尔

解析：3岁女孩，反复咳嗽2个月，查体：体温正常，浅表淋巴结（-），咽（-），两肺多哮鸣音，无水泡音，反复抗生素治疗不愈，以往无呛咳病史，有过敏性鼻炎等表现符合咳嗽变异型哮喘的诊断标准，如肺部哮鸣音广且持续存在，指处于哮喘持续状态。比索洛尔（B错，为本题正确答案）为β受体拮抗剂，用于高血压及开角型青光眼治疗，容易导致支气管痉挛，更不能用于支气管哮喘急性发作。但氨茶碱（A对）、地塞米松（C对）、异丙肾上腺素（D对）等为支气管扩张剂或肾上腺糖皮质激素，可缓解支气管平滑肌痉挛，减轻气道水肿，当支气管哮喘持续状态常并电解质紊乱，易发生代谢性酸中毒以及呼吸性酸中毒，在代酸严重的情况下可用碳酸氢钠（E对）纠正酸中毒。